容易导致龋病的是
A. 牙中牙
B. 畸形舌侧尖
C. 畸形舌侧窝
D. 畸形根面沟
E. 畸形中央尖

正确答案：C。畸形舌侧窝

解析：本题考查畸形舌侧窝。容易导致龋病的是畸形舌侧窝（C对）。畸形舌侧窝由于舌侧窝呈囊状深陷，容易滞留食物残渣，利于细菌滋生，再加上囊底存在发育上的缺陷，常易引起龋病、牙髓的感染、坏死及根尖周病变。牙中牙（A错）是牙内陷最严重的一种。牙呈圆锥状，且较其固有形态稍大，X线片示其深入凹陷部好似包含在牙中的一个小牙，其实陷入部分的中央不是牙髓，而是含有残余成釉器的空腔。畸形舌侧尖（B错）易遭磨损而引起牙髓及根尖周组织病变。畸形根面沟（D错）使跟沟底封闭不良，上皮在该处呈病理性附着，并形成骨下袋，成为细菌、毒素入侵的途径，易导致牙周组织的破坏。畸形中央尖（E错）是由于牙发育期，牙乳头组织向成釉器突起，在此基础上形成牙釉质和牙本质。一般均位于牙合面中央窝处，呈圆锥形突起，故称中央尖。半数的中央尖有髓角伸入，尖而长的中央尖容易折断或被磨损而露髓，而引发牙髓病或根尖周病。